属于迟发型超敏反应的试验是
A. 库姆试验
B. 抗毒素血清皮试
C. 青霉素皮试
D. OT试验（结核菌素试验）
E. 普鲁卡因皮试

正确答案：D。OT试验（结核菌素试验）